最容易发生损伤性骨化的部位是
A. 膝关节
B. 肘关节
C. 前臂
D. 上臂
E. 大腿

正确答案：B。肘关节

解析：损伤性骨化又称骨化性肌炎，多见于关节扭伤、脱位或关节附近骨折，特别多见于肘关节（B对）。膝关节（A错）多发生韧带和半月板的损伤。前臂（C错）易发生骨筋膜室综合征。上臂（D错）骨折可发生脂肪栓塞综合征也可引起骨筋膜室综合征。大腿（E错）骨折容易引起休克和脂肪栓塞综合征。